以下会出现无菌性白细胞尿的肾脏疾病是
A. 糖尿病肾小球硬化
B. 狼疮性肾炎
C. 膜性肾病
D. 肾脏淀粉样变
E. 微小病变

正确答案：B。狼疮性肾炎